下列胎心电子监测结果提示胎儿缺氧的是
A. 胎心出现无应激试验反应型
B. 胎心出现晚期减速
C. 胎心出现加速
D. 胎心出现变异减速
E. 胎心出现早期减速

正确答案：B。胎心出现晚期减速

解析：晚期减速（B对）一般是胎盘功能不良、胎儿缺氧的表现，因此能提示胎儿缺氧。无应激试验反应型（A错）为20分钟内至少有2次以上胎动伴胎心率加速>15次/分，胎心率110～160次/分，属正常情况，不能提示胎儿缺氧。加速（C错）的原因可能是胎儿躯干局部或脐静脉暂时受压；变异减速（D错）一般认为宫缩时脐带受压兴奋迷走神经引起；早期减速（E错）一般发生在第一产程后期，为宫缩时胎头受压引起，不受孕妇体位或吸氧而改变。